多巴胺的作用为
A. 激动M受体
B. 激动N受体
C. 激动多巴胺
D. 增加肾血流量
E. 保钠利尿

正确答案：B、C、D。激动N受体；激动多巴胺；增加肾血流量